采收加工时须撞去须根及粗皮的中药材是
A. 玄参
B. 丹参
C. 泽泻
D. 郁金
E. 川芎

正确答案：C。泽泻